某饭店举行婚宴。部分人餐后出现不同程度恶心、呕吐、腹痛、腹泻，其中脐部阵发性绞痛最为显著，腹泻物多为血水样、黏液样或脓血便。菜肴中有盐水虾、熏鱼等水产品。上述人群最有可能是
A. 葡萄球菌肠毒素食物中毒
B. 副溶血性弧菌食物中毒
C. 沙门菌食物中毒
D. 肉毒梭菌食物中毒
E. 腊样芽孢杆菌食物中毒

正确答案：B。副溶血性弧菌食物中毒

解析：副溶血性弧菌食物中毒（B对），该菌主要在海洋和河口环境中温暖和盐度较低水域生长。可存在于鱼类、贝壳类等海产品中。沙门菌食物中毒（C错）常见的食物主要为畜、禽肉类食品，其次为蛋类奶和奶制品，起病急，主要临床症状为发热、恶寒、呕吐、腹痛、水样腹泻，偶有黏液或脓性腹泻（P112）。肉毒梭菌食物中毒（D错）引起该病的食物主要是发酵豆制品（臭豆腐、豆瓣酱等），胃肠道症状很少见，以弛缓性瘫痪为主（P129）。上述人群最有可能是副溶血性弧菌食物中毒（B对）。